卵巢浆液性肿瘤来源于
A. 卵巢的生发上皮，向输卵管上皮分化
B. 卵巢的生发上皮，向宫颈粘膜分化
C. 卵巢的生发上皮，恶变
D. 卵巢的生发上皮，发生逆转现象
E. 卵巢的生发上皮，向子宫内膜分化

正确答案：A。卵巢的生发上皮，向输卵管上皮分化

解析：根据八版妇产科学：卵巢肿瘤来源于卵巢表面的生发上皮，具有分化为各种苗勒上皮的潜能，向输卵管上皮分化（A对），形成卵巢浆液性肿瘤；向宫颈黏膜分化（B错），形成黏液性肿瘤当向子宫内膜分化（E错），形成子宫内膜样肿瘤。卵巢浆液性肿瘤包括浆液性囊腺瘤、交界性浆液性囊腺瘤和浆液性囊腺癌，三者分别为良性、交界性和恶性肿瘤。而恶变是指良性肿瘤转变成恶性肿瘤，故“卵巢浆液性肿瘤来源于卵巢的生发上皮，恶变（C错）”这种说法不严谨。逆转现象（D错）是指肿瘤复发后再次手术见到未成熟肿瘤组织向成熟转化，多见于未成熟畸胎瘤，其来源于原始生殖细胞。